设计修复体龈缘的位置时不必考虑
A. 患牙的形态
B. 修复体的固位
C. 患牙的牙周状况
D. 患者的口腔卫生状况
E. 咬合力的大小

正确答案：E。咬合力的大小

解析：本题考查修复体龈边缘设计。设计修复体龈缘的位置时不必考虑咬合力的大小（E错，为本题的正确答案）。修复体龈缘的位置可分为龈上、龈下和齐龈，龈下肩台美观，适合于前牙的修复，但边缘处易堆积菌斑（C对），引起龈炎，加深盲袋，龈上肩台适用于牙龈退缩的老年患者（A对）。修复体应尽量位于龈上，易保持清洁，以及制备印模，龈下肩台是牙周炎的致病因素（D对）。修复体龈缘的位置使修复体有足够的固位力（B对），使其稳固地保持在患牙的位置上。